患者脘胁胀闷疼痛，嗳气吞酸，烦躁易怒，舌红苔薄黄，脉弦数。其证型是
A. 肝气郁结
B. 肝火上炎
C. 肝脾不调
D. 肝胃不和
E. 胃火炽盛

正确答案：D。肝胃不和

解析：肝气郁结，肝失疏泄，横逆犯胃，胃气郁滞，故胃脘、胁肋胀满疼痛，走窜不定，胃脘痞满；胃气上逆，胃失和降，则呃逆，嗳气；肝胃气滞，郁而化火，故吞酸嘈杂；胃受纳失职，故饮食减少；肝失疏泄，故情绪抑郁，善太息，甚则气郁化火；肝性失柔，则烦躁易怒；苔薄白，脉弦为肝气郁滞所致；舌苔薄黄，则为气郁化火之征（D对）。